含有副交感纤维的脑神经为
A. 动眼神经、舌咽神经、迷走神经、面神经
B. 三叉神经、面神经、迷走神经、舌咽神经
C. 动眼、滑车、展神经和三叉神经的眼神经
D. 舌咽、舌下、副、迷走神经
E. 动眼、三叉、迷走、面神经

正确答案：A。动眼神经、舌咽神经、迷走神经、面神经

解析：动眼神经含一般躯体运动纤维及一般内脏运动（副交感）纤维，一般躯体运动纤维发自中脑动眼神经核，一般内脏运动纤维发自中脑的动眼神经副核。舌咽神经为含有5种纤维成分的混合性脑神经：特殊内脏运动纤维、一般内脏运动纤维、一般内脏感觉纤维、特殊内脏感觉纤维、一般躯体感觉纤维。迷走神经是行程最长，分布范围最广的脑神经，含有四种纤维成分：一般内脏运动纤维、一般内脏感觉纤维、特殊内脏运动纤维、一般躯体感觉纤维。面神经为含有特殊内脏运动、一般内脏运动、特殊内脏感觉和一般躯体感觉等四种纤维成分的混合性脑神经（A对）。